慢性阻塞性肺疾病患者进行呼吸训练，属于
A. 第一级预防
B. 第二级预防
C. 第三级预防
D. 根本预防
E. 三早预防

正确答案：C。第三级预防